男，38岁。颈前包块3个月，近期包块稍增大，无不适。査体：甲状腺左叶下极2cm×lcm包块，质韧光滑，随吞咽上下移动。周围无明显肿大淋巴结。针吸涂片细胞学检查可疑恶性肿瘤，建议手术治疗，术中首先送快速病理。此时正确的切除范围是
A. 单纯包块切除
B. 连同包块周围少许的甲状腺组织切除
C. 左叶次全切除
D. 左叶全切加峡部切除
E. 左叶部分切除

正确答案：D。左叶全切加峡部切除

解析：患者甲状腺左下叶包块，针吸涂片细胞学检查可疑恶性肿瘤。对于该患者可疑结节的手术，正确的切除范围是左叶全切加峡部切除（D对），并作快速病理检查。既达到活检目的，同时也是一种治疗措施。单纯包块切除（A错）违反无瘤技术原则，即手术中任何操作均不接触肿瘤本身，以防止手术过程中肿瘤的种植和转移。分化型甲状腺癌的最小切除范围为腺叶切除。若快速病理回报确诊为恶性结节，连同包块周围少许的甲状腺组织切除（B错）、左叶次全切除（C错）、左叶部分切除（E错）三种方法均需对同一腺叶进行再次手术，更容易损伤甲状旁腺和喉返神经。